患儿，女，4岁半，身高110cm，体重15kg。一天前开始发热（39.1℃），咽稍痛，无咳嗽，无吐泻，家长在家选用退烧药对症治疗。发病20h左右出现腹泻，约2～3h一次大便，量少，黄色黏液便，呕吐1次。体格检查：T38.8℃，P118次/分，R28次/分，咽微充血，出现轻微脱水症状。双肺呼吸音清，腹平，肝脾未触及，肠鸣音活跃，实验室检查：WBC18.5×10⁹/L（参考值4.0×10⁹～10.0×10⁹/L），粪便镜检可见红、白细胞。关于该患儿腹泻家庭用药教育的说法，错误的是
A. 每次腹泻后均要少量多次喂水，直至腹泻停止
B. 若患儿腹泻加重，可口服自制补液盐进行补液
C. 若症状不能改善，可及时加用诺氟沙星
D. 应给予少量、多次、清淡饮食
E. 若患儿出现粪便带血等症状，必须及时就医

正确答案：C。若症状不能改善，可及时加用诺氟沙星

解析：本题考查腹泻用药教育。诺氟沙星为喹诺酮类药物，禁用于18岁以下儿童（C错，为本题正确答案）。